两性性生理活动的基础知识包括
A. 性生理活动的调控有健全的神经、内分泌调节系统
B. 正常的性器官以及必要的性刺激
C. 性功能发挥的过程：一次健康而完整的性功能发挥的过程是从性欲开始被唤起直到平复，称为一个性反应周期，可分为五个紧密衔接的阶段，有性欲期、兴奋期、平台期、高潮期和消退期
D. 一个性反应周期所需时间的长短因人而异
E. 性生活的和谐，快乐、幸福取决于正确的性心理，正常的生殖器以及健全的神经内分泌调节

正确答案：C。性功能发挥的过程：一次健康而完整的性功能发挥的过程是从性欲开始被唤起直到平复，称为一个性反应周期，可分为五个紧密衔接的阶段，有性欲期、兴奋期、平台期、高潮期和消退期

解析：本题考查两性性生理活动的基础知识。一次健康而完整的性功能发挥的过程是从性欲开始被唤起直到平复，称为一个性反应周期。性反应是一种复杂的反应，包括生理、情绪、经历、信仰、生活方式及它们之间的相互关系。人类性反应周期是一个连续变化的过程，可人为地划分为五个时期：有性欲期、兴奋期、平台期、高潮期和消退期（C对ABDE错）。